女，出生11天。不能张口吸乳，偶有咳嗽、蹩眉，头后仰，上肢屈曲，下肢伸直，手半握拳状，无呼吸困难。其最可能的诊断是
A. 小儿搐搦症
B. 小儿癫痫
C. 呼吸道感染
D. 产后颅内血肿
E. 破伤风

正确答案：E。破伤风

解析：患儿，头后仰、上肢屈曲、下肢伸直、手半握拳状的临床表现叫做角弓反张，角弓反张是破伤风最特异表现，应诊断为破伤风（E对）。小儿抽搐症多在4～12岁起病，发作时会不自主的抽动（此患者没有抽动，而是肌肉的僵直），同时伴有爆发性发生和秽语，与该患者的各种临床表现不符（A错）。小儿癫痫是由于大脑皮层乱发电引起的，表现为频繁的抽搐，而不是角弓反张，因此不能诊断为小儿癫痫（B错）。呼吸道感染多由病毒感染引起，表现为咳嗽、流涕、发热等，该患儿并没有上呼吸道感染这些症状（C错）。产后颅内血肿的典型表现在脑部（如脑膜刺激症、脑水肿等），而不是肢体的抽搐（D错）。